五行中具有“曲直”特性的是
A. 木
B. 火
C. 土
D. 金
E. 水

正确答案：A。木

解析：本题考查五行属性，属于理解记忆内容。木曰曲直（A对），水曰润下（E错），火曰炎上（B错），金曰从革（D错），土爰稼穑（C错）。